有关心脏的描述，正确的是
A. 是血液循环的动力器官
B. 是由平滑肌构成的中空性器官
C. 心脏跳动是随意的
D. 是位于后纵隔内的器官
E. 以上都不对

正确答案：A。是血液循环的动力器官

解析：心脏是血液循环的动力器官（A对）。是由心肌（B错）构成的中空性器官。是位于胸腔的中纵隔（D错）内的器官。